属于支气管扩张手术治疗禁忌症的是
A. 双下肺均存在局限性支气管扩张病变
B. 合并反复感染
C. 窦性心动过缓，阿托品实验（+）
D. 合并大咯血
E. 合并肺心病

正确答案：E。合并肺心病

解析：支气管扩张的外科治疗手术禁忌证：①一般情况差，心、肺、肝、肾功能不全，不能耐受手术者（C错）；②双肺弥漫性病变（A错）；③合并肺气肿、哮喘或肺源性心脏病者（E对）。手术适应证：①一般情况良好，心、肝、肾等重要器官功能可以耐受手术；②规范内科治疗6个月以上症状无减轻；③病变相对局限（A错）；④症状明显，如持续咳嗽、大量咳痰（B错）、反复或大量咯血（D错）（八版外科学P277）。